新型隐球菌引起的主要疾病是
A. 慢性脑膜炎
B. 流行性脑脊髓膜炎
C. 流行性乙型脑炎
D. 鹅口疮
E. 原发性非典型肺炎

正确答案：A。慢性脑膜炎